正常足月儿生后母乳喂养开始时间是
A. 0.5小时
B. 2.5小时
C. 3小时
D. 3.5小时
E. 4小时

正确答案：A。0.5小时

解析：人乳是满足婴儿心理和生理发育的天然的最好的食物，对婴儿的健康生长发育有不可替代的作用。建立良好的母乳喂养方法，其中尽早开奶时应以产后15分钟至2小时为宜（A对）。